患者，女性，56岁。洗澡时无意发现一颈部肿物来就诊，诉曾有过腹泻，心慌，抽搐等症状，但未在意，查见：其颜面潮红，实验室检查其血钙较低。则该患者可能患有
A. 甲状腺脓肿
B. 甲状腺髓样癌
C. 甲亢
D. 甲状腺炎
E. 以上都不对

正确答案：B。甲状腺髓样癌

解析：本题考查甲状腺髓样癌。患者，女性，56岁。洗澡时无意发现一颈部肿物来就诊，诉曾有过腹泻，心慌，抽搐等症状，但未在意，查见：其颜面潮红，实验室检查其血钙较低。则该患者可能患有甲状腺髓样癌（B对E错）。甲状腺脓肿（A错）较少见,常由化脓性细菌引起,临床表现为甲状腺局部红、肿、热、痛,常伴有全身中毒症状。甲亢（C错）的临床表现包括甲状腺肿大、性情急躁容易激动、失眠、两手颤动怕热、多汗、皮肤潮湿、食欲亢进但消瘦、体重减轻、心悸、脉快有力（脉率常在每分钟100次以上，休息及睡眠时仍快）、脉压增大（主要由于收缩压升高）、内分泌紊乱（如月经失调）以及无力易疲劳、出现肢体近端肌萎缩等。其中脉率增快及脉压增大尤为重要，常可作为判断病情程度和治疗效果的重要标志。甲状腺炎（D错）是一种常见的甲状腺疾病，女性多见；临床表现多种多样，同一种类型的甲状腺炎在病程的不同时期不仅可以表现为甲状腺机能亢进，还可表现为甲状腺功能减退，可以表现为弥漫性甲状腺病变，还可以表现为甲状腺结节，有时不同类型的甲状腺炎可以互相转换。